已检的合格产品
A. 绿色
B. 红色
C. 蓝色
D. 白色
E. 黄色

正确答案：A。绿色

解析：本题考查药品储存要求。已检的合格产品为绿色（A对）。在人工作业的库房储存药品，按质量状态实行色标管理：合格药品为绿色，不合格药品为红色（B错），待确定药品为黄色（E错）。